在Ab产生的一般规律中，初次应答产生最早，具有早期诊断价值的Ig是
A. IgG
B. IgM
C. sIgA
D. IgE
E. IgD

正确答案：B。IgM

解析：初次体液免疫应答的特点是潜伏期较长，约1周以上；产生抗体的滴度低；抗体维持的时间短；产生的抗体多为低亲和力的IgM。掌握“B细胞、T细胞介导的免疫应答”知识点。